女，50岁。牙龈增生影响咀嚼一年。检查见全口牙龈肥大增生，覆盖牙面约1/2，结节状。探诊时有出血，个别牙龈增生严重处牙齿有移位。为了有助于诊断，最应该注意询问的病史为服药史，如果该患者进行过肾移植手术，并在一年中一直接受治疗，则最有可能的诊断是药物性牙龈增生，导致该病的主要原因是
A. 免疫抑制剂环孢素
B. 遗传因素
C. 螺旋体
D. 白细胞大量浸润
E. 血压过高

正确答案：A。免疫抑制剂环孢素

解析：本题考查药物性牙龈肥大的病因。该患者进行了肾移植，因此会服用免疫抑制剂—环孢素，环孢素服药者有30%～50%发生牙龈纤维性增生，故导致患者出现牙龈增生的主要原因是服用了免疫抑制剂环孢素（A对）。遗传因素（B错）是导致牙龈纤维瘤病的主要原因。螺旋体（C错）是急性坏死性溃疡性龈炎的主要病原菌之一。白细胞大量浸润（D错）可为白血病的牙龈病损的表现。血压过高（E错）可使患者因服用钙通道阻滞剂而导致药物性龈肥大，但是该病例中并未提及患者有高血压病史，故不考虑这种原因。